下列哪一类毒物中毒后在两个发病期间存在一个潜伏期
A. 有机溶剂
B. 刺激性气体
C. 化学性窒息性气体
D. 有机磷农药

正确答案：B。刺激性气体

解析：本题考查刺激性气体的潜伏期。刺激性气体（B对ACD错）引起的肺水肿，临床过程可分为四期：（1）刺激期：吸入剌激性气体后表现为气管-支气管黏膜的急性炎症；（2）潜伏期：刺激期后，自觉症状减轻或消失，病情相对稳定，但肺部的潜在病理变化仍在继续发展，经过一段时间发生肺水肿，实属“假象期”；（3）肺水肿期：潜伏期之后，突然出现加重的呼吸困难，烦躁不安、大汗淋漓、剧烈咳嗽、咳大量粉红色泡沫样痰；（4）恢复期：经正确治疗，如无严重并发症，肺水肿可在2～3天内得到控制，症状体征逐步消失。